可用于制备溶蚀性骨架片的是
A. 羟丙基甲基纤维素
B. 单硬脂酸甘油酯
C. 大豆磷脂
D. 无毒聚氯乙烯
E. 乙基纤维素

正确答案：B。单硬脂酸甘油酯

解析：本题考查骨架型缓释材料。溶蚀性骨架材料是指疏水性强的脂肪类或蜡类物质，如动物脂肪、蜂蜡、巴西棕榈蜡、氢化植物油、硬脂醇、单硬脂酸甘油酯（B对）、硬脂酸丁酯等，可延滞水溶性药物的溶解、释放过程。羟丙甲纤维素（HPMC）（A错）为亲水凝胶骨架材料。豆磷脂（C错）为制备脂质体的材料。无毒聚氯乙烯（D错）和乙基纤维素（E错）为不溶性骨架材料。